“通因通用”适用于
A. 脾虚泄泻
B. 肾虚泄泻
C. 食积泄泻
D. 肠虚滑脱
E. 以上均非

正确答案：C。食积泄泻

解析：通因通用，即以通治通，是指用通利的药物来治疗通泻症状的实证，适用于因实邪内阻出现通泄症状的真实假虚证。一般情况下，对于泄泻多用止泻的方法，但如果通泄的症状出现在实性病证中，则当以通治通。如食积内停，阻滞胃肠，导致腹痛泄泻，泻下物臭如败卵时，不仅不能止泻，相反应消食而导滞攻下，推荡积滞，使食积去而泻自止（C对）。脾虚泄泻（A错），肾虚泄泻（D错），肠虚滑脱（D错）均为虚症泄泻，根据“虚则补之”治则，当用补益的方法。